患者，女，60岁。反复发作胸闷胸痛半月余，痰多白黏，纳呆，脘胀，形寒肢冷，舌苔白腻，脉弦滑。心电图V₃、V₄、V₅、V₆导联ST段下移，T波倒置。其证型是
A. 痰湿痹阻
B. 气阴两虚
C. 寒痰痹阻
D. 气血不足
E. 肝气郁结

正确答案：C。寒痰痹阻

解析：痰浊盘踞，胸阳失展，故反复发作胸闷胸痛，痰多白黏；痰浊困脾，脾气不运，故纳呆，腹胀，形寒肢冷；舌苔白腻，脉弦滑，均属于寒痰阻滞心脉之侯，其证型是寒痰痹阻（C对）。痰湿痹阻证（A错）的表现为胸闷痛如窒，气短痰多，肢体沉重，形体肥胖，纳呆恶心。气阴两虚证（B错）的特点为胸闷隐痛，时作时止，心悸气短，倦怠懒言，头晕目眩，心烦多梦，或手足心热。气血不足证（D错）的特点为胸闷隐痛，时作时止，心悸气短，倦怠懒言，面色苍白，头晕目眩。肝气郁结证（E错）表现为心胸满闷，隐痛阵作，遇情志不遂时诱发或加剧，或兼有脘胀嗳气，时欲太息。